医学道义论要求医生
A. 从医学自身规律和治疗疾病的内在要求出发，尽到一切医者应尽的职责
B. 尽到法律法规所要求的职责
C. 从良心出发尽职尽责
D. 从规则出发尽职尽责
E. 重视行为的后果

正确答案：A。从医学自身规律和治疗疾病的内在要求出发，尽到一切医者应尽的职责

解析：道义论在道德评价中注重行为本身是否符合道德规定，强调行为的动机而不是以结果为评价善恶的依据，因此也有人把道义论称为动机论，认为只要行为的动机是善的不管结果如何个行为都是道德的。医学道义论要求医生从医学自身规律和治疗疾病的内在要求出发，尽到一切医者应尽的职责（A对BCD错）。后果论作为一种道德理论，它主张人的行为道德与否，看行为的后果（E错）。